不属奇恒之府的是
A. 脑
B. 髓
C. 骨
D. 筋
E. 女子胞

正确答案：D。筋

解析：该题考查奇恒之府的内容，理解记忆即可。